一位伤寒患者住在传染病房治疗，此时应采取
A. 预防性消毒
B. 终末消毒
C. 随时消毒
D. 化学消毒
E. 物理消毒

正确答案：C。随时消毒

解析：本题考查随时消毒。随时消毒是指当传染源还在疫源地时，对其排泄物、分泌物、被污染的物品及场所进行的及时消毒。一位伤寒患者住在传染病房治疗，此时应采取随时消毒（C对ABDE错）。